于皮里膜外，有脂肪过度增生而形成是良性肿瘤是
A. 血瘤
B. 肉瘤
C. 脂瘤
D. 脂肪肉瘤
E. 失荣

正确答案：B。肉瘤

解析：血瘤是指体表血络扩张，纵横丛集而形成的肿瘤（A错）。肉瘤是发于皮里膜外，由脂肪组织过度增生而形成的良性肿瘤（B对）。《医宗金鉴·外科心法要诀》中记载，软而不破，皮色淡红者，名脂瘤，即粉瘤也（C错）。脂肪肉瘤是起源于脂肪细胞和向脂肪细胞分化的不同阶段的间叶细胞的一种恶性肿瘤（D错）。失荣是发于颈部及耳之前后的岩肿，因其晚期气血亏乏，面容憔悴，形体消瘦，状如树木枝叶发枯，失去荣华而命名（E错）。